患者不顾病情而从事力所不及的活动是
A. 角色行为异常
B. 角色行为冲突
C. 角色行为适应
D. 角色行为强化
E. 角色行为减退

正确答案：E。角色行为减退

解析：角色行为减退：已进入角色的患者，由于强烈的感情需要，或因环境、家庭、工作等因素，或由于正常社会角色的责任、义务的吸引，可使患者角色行为减退。此时，患者不顾病情而从事力所不及的活动，承担正常角色时的社会行为，从而影响疾病的治疗。例如，一位患病住院治疗的士兵，在病情没有完全康复的时候就偷偷跑出医院回到部队，结果因劳累使病情加重。这就是军人角色冲击了患者角色，造成患者角色减退的表现。掌握“患者角色和求医行为”知识点。